原植物属于菊科的中药材有
A. 乌梅
B. 瓜蒌
C. 沙苑子
D. 艾叶
E. 牛蒡子

正确答案：D、E。艾叶；牛蒡子

解析：本题考查的是艾叶与牛蒡子的来源。原植物属于菊科的中药材有艾叶（D对）与牛蒡子（E对）。艾叶：【来源】为菊科植物艾的干燥叶。牛蒡子：【来源】为菊科植物牛蒡的干燥成熟果实。乌梅（A错）：【来源】为蔷薇科植物梅的干燥近成熟果实。瓜蒌（B错）：【来源】为葫芦科植物栝楼或双边栝楼的干燥成熟果实。沙苑子（C错）：【来源】为豆科植物扁茎黄芪的干燥成熟种子。